在心动周期中，心室内压力上升最快的是在
A. 快速射血期
B. 快速充盈期
C. 减慢射血期
D. 等容舒张期
E. 等容收缩期

正确答案：E。等容收缩期

解析：在心动周期中，心室内压力上升最快的阶段是等容收缩期（E对），此期心室收缩但却不能改变心室容积，因而心室急剧收缩只能使室内压急剧上升。快速射血期（A错）的血液很快进入主动脉，心室容积缩小，但由于心室肌收缩，心室内压力上升并达到峰值，但其上升幅度并不是最大。快速充盈期（B错），由于心室肌很快舒张，心室内压力明显降低，甚至形成负压才能对心房和大静脉形成“抽吸”作用。减慢射血期（C错）的心室内压力由峰值逐渐下降。等容舒张期（D错）心室开始舒张，心室内压力下降。